谷胱甘肽是内源性的小分子化合物，在体内参与多种药物或毒物及其代谢产物的结合代谢，起到解毒作用。关于谷胱甘肽结构和性质的说法，错误的是
A. 为三肽化合物
B. 结构中含有巯基
C. 具有亲电性质
D. 可清除有害的亲电物质
E. 具有氧化还原性质

正确答案：C。具有亲电性质

解析：本题考查谷胱甘肽结构和性质。谷胱甘肽具有亲核性质，而不是亲电性质（C错，为本题正确答案）。谷胱甘肽是含有巯基（B对）的三肽化合物（A对）。巯基（-SH）具有较好亲核作用，在体内起到清除代谢产生的有害亲电性物质（D对）的作用。此外，谷胱甘肽还有氧化还原性质（E对），对药物及代谢物的转变起到重要的作用。